按十二经脉气血流注次序，手太阳小肠经上接
A. 手太阴肺经
B. 足少阴肾经
C. 手少阴心经
D. 手少阳三焦经
E. 足太阳膀胱经

正确答案：C。手少阴心经

解析：手太阳小肠经上接手少阴心经（C对）。手太阴肺经上接足厥阴肝经（A错）。足少阴肾经上接足太阳膀胱经（B错）。手少阳三焦经上接手厥阴心包经（D错）。足太阳膀胱经上接手太阳小肠经（E错）。十二经脉交接次序顺口溜：肺大胃脾心小肠，膀肾包焦胆肝详。